男性，30岁。呼吸困难2天就诊，发作前有鼻痒、喷嚏。既往有类似病史。体检：呼吸20次/分，呼气末闻及哮鸣音，心率96次/分，律齐。治疗首选药物是
A. 酮替酚
B. 色甘酸二钠
C. 沙丁胺醇
D. 泼尼松
E. 特非那定

正确答案：C。沙丁胺醇